患者，女，74岁。确诊支气管肺癌1个月，拒绝西医治疗，请中医诊治。现症见：刺激性咳嗽，偶有痰中带血，心烦，少寐，手足心热，盗汗，口渴，大便秘结，舌质红，苔薄黄，脉细数。治疗应首选的方剂是
A. 生脉饮
B. 血府逐瘀汤
C. 导痰汤
D. 沙参麦冬汤合五味消毒饮
E. 沙参麦冬汤

正确答案：D。沙参麦冬汤合五味消毒饮

解析：本题支气管肺癌患者由于肺阴亏虚，虚热内灼，肺失滋润，肃降无权，肺气上逆，则见咳嗽；虚火灼津为痰，肺损络伤，故见痰中带血；阴虚肺燥，津液不能濡润上承，则口干咽燥；阴虚火旺则心烦，少寐，手足心热，盗汗，大便秘结，舌质红，苔薄黄，脉细数，治应养阴清热，解毒散结，用沙参麦冬汤合五味消毒饮（D对）。生脉饮（A错）益气复脉，养阴生津，主治气阴两亏，心悸气短，脉微自汗。血府逐瘀汤（B错）用于气滞血瘀证，以化瘀散结，行气止通。导痰汤（C错）主治痰涎壅盛，胸膈痞塞，咳嗽恶心，以燥湿豁痰，行气开郁。沙参麦冬汤（E错）用于支气管肺癌之气阴两虚证，以益气养阴，化痰散结。